属于“疗热以寒药”治疗原则的是
A. 用附子干姜治疗腹中冷痛脉沉无力
B. 用猪苓茯苓治疗水肿小便不利
C. 用黄芩板蓝根治疗发热口渴咽痛
D. 用山茱萸五味子治疗虚汗遗精
E. 用麻黄薄荷治疗表证

正确答案：C。用黄芩板蓝根治疗发热口渴咽痛

解析：黄芩苦寒，入肺经，长于清肺热，为治肺热咳嗽之要药。板蓝根苦寒，入心、胃经，有类似大青叶的清热解毒之功，而以解毒利咽散结见长（C对）。附子辛甘温煦，有峻补元阳、益火消阴之效，《本草汇言》称其“乃命门主药”；能上助心阳、中温脾阳、下补肾阳，为“回阳救逆第一品药”。干姜辛热燥烈，主入脾胃而长于温中散寒、健运脾阳，“治感寒腹痛”，为温暖中焦之主药；本品辛热，入心、脾、肾经，有温阳守中，回阳通脉的功效（A错）。茯苓味甘而淡，甘则能补，淡则能渗，药性平和，既可祛邪，又可扶正，利水而不伤正气，实为利水消肿之要药，可用治寒热虚实各种水肿。猪苓甘淡渗泄，利水渗湿作用较强，用于水湿停滞的水肿，单用即可（B错）。山茱萸酸涩微温质润，其性温而不燥，补而不峻，既能补肾益精，又能固精缩尿；能敛汗固脱，为防止元气虚脱之要药。五味子酸涩收敛，性寒清降，功能敛肺止汗，入肾经能涩精止遗（D错）。麻黄味辛发散，性温散寒，主入肺经，善于宣肺气、开腠理、透毛窍而发汗解表，发汗力强，为发汗解表之要药。薄荷辛以发散，凉以清热，清轻凉散，其辛散之性较强，是辛凉解表药中最能宣散表邪，且有一定发汗作用之药，为疏散风热常用之品（E错）。